临床上亚急性硬脑膜下血肿发生的时间指
A. 2天-3周
B. 1天-3周
C. 1天-2周
D. 3天-3周
E. 1周-3周

正确答案：D。3天-3周

解析：硬脑膜下血肿约占外伤性颅内血肿的40%，多属急性或亚急性型（P192）。临床上亚急性硬脑膜下血肿发生的时间指3天-3周（D对）。